薄荷除宣散风热、清利头目外，又能
A. 疏肝
B. 息风止痉
C. 祛风止痛
D. 明目退翳
E. 清热解毒

正确答案：A。疏肝

解析：本题考查的是薄荷的功效。薄荷除宣散风热、清利头目外，又能疏肝（A对）。薄荷【功效】宣散风热，清利头目，利咽，透疹，疏肝。天麻【功效】息风止痉（B错），平抑肝阳，祛风通络。徐长卿【功效】祛风止痛（C错），活血通络，止痒，解蛇毒。蝉蜕【功效】疏散风热，透疹止痒，明目退翳（D错），息风止痉。升麻【功效】发表透疹，清热解毒（E错），升举阳气。